男，60岁。间断发热2周，尿黄伴乏力纳差1周，症状逐渐加重，出现恶心呕吐，既往体健，无肝病史，病前无饮酒服药史，病前3周曾去外地旅游。查体：神志清楚，皮肤巩膜黄染，肝肋下2cm，脾肋下刚触及，腹水征；实验室检査：ALT1500U/L，TBil80μmol/L。该患者应首先考虑的诊断是
A. 急性庚型肝炎
B. 急性乙型肝炎
C. 急性丙型肝炎
D. 急性丁型肝炎
E. 急性戊型肝炎

正确答案：E。急性戊型肝炎

解析：60老年男性患者，既往体健，无肝病史，患者在3周前去外地旅游，间断发热2周，尿黄伴乏力纳差1周，症状逐渐加重，出现恶心呕吐（急性肝炎感染症状），病前无饮酒服药史（排除药物性肝损害、酒精性肝病），查体神志清楚，皮肤巩膜黄染，肝肋下2cm，脾肋下刚触及，腹水征；实验室检査ALT1500U/L（正常参考值0～40U/L），TBil80μmol/L（正常参考值3.4～17.1μmol/L），因各型急性肝炎的临床症状无特异性，结合患者既往史及外地旅史，及老年急性病毒性肝炎以戊型肝炎较多见（黄疸型为主），首先考虑的诊断是急性戊型肝炎（E对），急性戊型肝炎流是经粪-口途径传播的，其中以水型流行最常见，少数为食物型暴发或日常生活接触传播。